为消除可摘局部义齿不稳定，以下方法错误的是
A. 增加对抗平衡固位体
B. 尽力设计黏膜支持式义齿
C. 在支点或支点线的对侧加平衡力
D. 消除（牙合）支托、卡环在余留牙上形成的支点
E. 消除基托下与组织形成的支点

正确答案：B。尽力设计黏膜支持式义齿

解析：本题考查义齿不稳定的消减方法。为消除可摘局部义齿不稳定，以下方法错误的是尽力设计黏膜支持式义齿（B错，为本题的正确答案）。由于黏膜具有可让性，设计黏膜支持式义齿会增加义齿不稳定。义齿不稳定的消减方法从力矩平衡和消除支点两方面着手。由于平衡力与（牙合）力位于支点线的两侧，当平衡力矩大于（牙合）力矩时，义齿保持平衡、稳定，故在义齿的支点或支点线对侧设置间接固位体来增加平衡力（AC对）。可摘局部义齿若存在支托、卡坏等在余留牙上形成的支点（D对）或者基托与基托下组织形成的支点（E对）会增加义齿的不稳定，故消除此两类支点有利于可摘局部义齿保持稳定。